弱碱性药物
A. 在酸性环境中易跨膜转运
B. 在胃中易于吸收
C. 酸化尿液时易被重吸收
D. 酸化尿液时可加速其排泄
E. 碱化尿液时可加速其排泄

正确答案：D。酸化尿液时可加速其排泄

解析：本题考查弱碱性药物。碱性药物在pH高的环境中非解离型药物增加（C错），未解离的分子型药物易于透过细胞膜，可加速其排泄（D对）。